关于肾脂肪囊的描述，错误的是
A. 经肾门与肾窦内的脂肪相连
B. 同时也包裹肾上腺
C. 为肾纤维囊外周的脂肪组织
D. 向下与浅筋膜的脂肪相连
E. 在肾的边缘处脂肪较多

正确答案：D。向下与浅筋膜的脂肪相连

解析：脂肪囊在纤维囊外周（C对）紧密包裹肾脏，经肾门与肾窦内的脂肪相连（A对），在肾的边缘处脂肪较多（E对）。脂肪囊同时也包裹肾上腺（B对），向下与髂筋膜（D错，为本题正确答案）相连，髂筋膜为深筋膜。